下列属于越轨行为的是
A. 环境污染问题
B. 青少年犯罪问题
C. 劳动就业问题
D. 犯罪行为
E. 就业问题

正确答案：D。犯罪行为

解析：本题考查越轨行为。越轨行为是指违背群体标准或期望的行为，如各种违法违纪行为、犯罪行为（D对ABCE错）等。